活髓牙牙体预备后，粘结临时冠时最好选用
A. 玻璃离子水门汀
B. 磷酸锌水门汀
C. 聚羧酸锌水门汀
D. 丁香油糊剂
E. 以上均可

正确答案：D。丁香油糊剂

解析：丁香油糊剂：既可避免对刺激牙髓，安抚已受激惹的牙髓，又可保持患牙的牙位和修复间隙，为戴冠提供便利。掌握“修复体试戴、磨光与粘固”知识点。